下列哪个核团发出舌咽神经的一般内脏运动纤维
A. 下橄榄核
B. 疑核
C. 下泌涎核
D. 楔束核
E. 孤束核

正确答案：C。下泌涎核

解析：舌咽神经含有5种纤维成分，其中一般内脏运动纤维发自于下泌涎核（C对）；特殊内脏运动纤维发自于疑核（B错）。